下列软膏基质中，属于水溶性基质的是
A. 蜡
B. 石蜡
C. 聚乙二醇
D. 植物油
E. 氢化植物油

正确答案：C。聚乙二醇

解析：本题考查的是不同软膏基质的水溶性。下列软膏基质中，属于水溶性基质的是聚乙二醇（C对）。聚乙二醇：为乙二醇的高分子聚合物。聚乙二醇性质稳定，可与多数药物配伍，不宜酸败和发霉；能与水、乙醇、丙酮及三氯甲烷混溶。蜂蜡（A错）：②蜂蜡：有黄蜡、白蜡之分。常用麻油与蜂蜡熔合为基质。石蜡（B错）：为多种固体烃的混合物，可与脂肪油、蜂蜡等熔合。植物油（D错）与氢化植物油（E错）属于油脂类，油脂类：系从动物或植物中获得的高级脂肪酸甘油酯及其混合物。常用的有动、植物油，氢化植物油等。植物油常与熔点较高的蜡类熔合制成稠度适宜的基质。